根据临床治疗需要，既可麸炒又可土炒的饮片是
A. 芡实
B. 僵蚕
C. 白术
D. 枳壳
E. 薏苡仁

正确答案：C。白术

解析：本题考查的是白术的炮制方法。根据临床治疗需要，既可麸炒又可土炒的饮片是白术（C对）。麸炒是将净制或切制后的药物用麦麸熏炒的方法。麸炒的目的：①增强疗效，如山药、白术、芡实（A错）等。②缓和药性，如苍术、枳实、薏苡仁（E错）等。③矫臭矫味，如僵蚕（B错）等。土炒：将净选或切制后的药物与灶心土（伏龙肝）拌炒的方法。亦有用黄土、赤石脂炒者。土炒的目的：灶心土味辛性温，能温中燥湿，止呕，止泻。故常用来炮制补脾止泻的药物。如白术、山药等。白术：【炮制方法】处方用名有白术、土炒白术、麸炒白术。①白术：取原药材，除去杂质，用水洗净，润透，切厚片，干燥，筛去碎屑。②土炒白术：先将土置锅内，用中火加热，炒至土呈灵活状态时，投入白术片，炒至白术表面均匀挂上土粉时，取出，筛去土粉，放凉。每100kg白术片，用灶心土25kg。③麸炒白术：先将锅用中火烧热，撒入麦麸（或蜜炙麦麸），待冒烟时，投入白术片，不断翻炒，至白术呈焦黄色，逸出焦香气，取出，筛去麦麸，放凉。每100kg白术片，用麦麸10kg。【炮制作用】白术味甘、苦，性温。归脾、胃经。具有健脾益气，燥湿利水，止汗，安胎的功能。①白术以健脾燥湿、利水消肿为主，生品与炒品相比祛湿力强，用于脾虚食少，腹胀泄泻，痰饮眩悸，水肿，自汗，胎动不安。②土炒白术，借土气助脾气，长于补脾止泻而安胎，用于脾虚食少、泄泻便溏、胎动不安。③麸炒白术，借麸味甘入中之性，以缓和白术的燥性，增其健脾之功，并兼消胀之能。用于脾气虚弱、中焦不和、运化失常所致的食少胀满、倦怠乏力。枳壳（D错）采用麸炒法炮制。